在执业地点取得相应处方权的是
A. 试用期的医师
B. 实习医师
C. 见习医师
D. 经注册的执业医师
E. 经注册的执业助理医师

正确答案：D。经注册的执业医师

解析：在执业地点取得相应处方权的是经注册的执业医师（D对）。试用期的医师（A错）、实习医师（B错）、见习医师（C错）不具备处方权。经注册的执业助理医师在医疗机构开具的处方，经所在执业地点执业医师签名或加盖专用签章后方有效（E错）。